患者男性，60岁，口渴欲饮6年，近半年小便频数，混浊如膏，甚则饮一溲一，面色黧黑，耳轮焦干，腰膝酸软，形寒畏冷，阳痿，舌淡苔白，脉沉细无力。其治疗主方为
A. 六味地黄丸加减
B. 消渴方加减
C. 玉女煎加减
D. 七味白术散加减
E. 肾气丸加减

正确答案：E。肾气丸加减

解析：本题患者为消渴病，肾失濡养，开阖固摄失权，水谷精微直趋下泄，故而小便频数，混浊如膏，甚则饮一溲一；肾精亏虚则致面色黛黑，耳轮焦干，腰膝酸软；肾阳虚则形寒畏冷，阳痿不举，舌淡苔白，肾阴阳两虚，脉则沉细无力。治应滋阴温阳，补肾固摄，用金匮肾气丸加减（E对）。六味地黄丸加减（A错）用于下消，肾阴亏虚证，滋阴固肾。消渴方加减（B错）用于上消，肺热津伤证，清热润肺，生津止渴。玉女煎加减（C错）用于中消，胃热炽盛证，以清泻胃火，滋阴增液。七味白术散加减（D错）用于气阴两虚证，以益气健脾，生津止渴。